外周血中全血细胞减少，Hams试验阴性
A. 阵发性睡眠性血红蛋白尿
B. 缺铁性贫血
C. 再生障碍性贫血
D. 巨幼细胞性贫血
E. 自身免疫性溶血性贫血

正确答案：C。再生障碍性贫血

解析：外周血中全血细胞减少常见于再生障碍性贫血、阵发性睡眠性血红蛋白尿等；Hams试验（酸溶血试验）是红细胞对补体的敏感性试验，其阳性是阵发性睡眠性血红蛋白尿（A错）经典的确诊试验，具有很高的特异性；再生障碍性贫血（C对）时，外周血中全血细胞减少，Hams试验阴性。缺铁性贫血（P541）（B错）、巨幼细胞性贫血（P544）（D错）是由于造血原料缺乏导致红细胞生成减少而引起的贫血，白细胞、血小板多正常；自身免疫性溶血性贫血（P557）（E错）是由于红细胞破坏过多导致红细胞减少而引起的贫血，白细胞、血小板多正常。